易引起基牙牙周组织损伤的是
A. 单端固定桥
B. 半固定桥
C. 种植固定桥
D. 复合固定桥
E. 双端固定桥

正确答案：A。单端固定桥

解析：本题考查局部固定义齿的类型。易引起基牙牙周组织损伤的是单端固定桥（A对）。单端固定桥粘固在一端基牙上。这种设计，增大了扭力矩，基牙极易倾斜、扭转而引起牙周组织创伤，故一般不能单独使用，尤其不可用于后牙，只在缺牙间隙小时慎用，或用于复合固定桥的个别小间隙。半固定桥（B错）又称应力中断式固定桥，桥体两端都有固位体，其一端桥体与固位体之间为固定连接体，另一端为非固定相连，多用于牙间隔缺失作复合桥时中间基牙的远中部分；或当某基牙倾斜度较大、若采用双端固定桥修复，难以取得共同就位道时，这时可将两个基牙的就位道分别设计，在一个固位体上设计的栓道与另一个基牙预备体的就位道一致，从而可避免牙体组织切割过多而露髓。种植固定桥（C错）又称为种植基牙固定桥或者种植基固定桥。种植体由人工材料制作，经牙槽外科手术植入缺牙区的牙槽骨和颌骨内，起着人工牙根的支持作用。有种植基牙支持的种植基牙固定桥；有种植基牙和相邻缺隙侧的天然牙共同支持的游离端种植基牙固定桥和中间种植基牙固定桥三类。种植基牙固定桥在缺牙间隙内至少有二枚种植体，缺牙数量增多时，要适当增加种植体数目。在牙弓的游离缺失的部位植入种植体后，用种植体和天然牙共同支持，将常规只能设计可摘局部义齿修复的病例改作游离端种植基牙固定桥，减小了义齿的体积，改善了义齿的功能，满足了患者制作固定桥的要求。在较长的缺牙间隙中植入种植体作中间基牙后，将长的固定桥改为复合固定桥，这种中间种植基牙固定桥减轻了两端基牙的负担。复合固定桥（D错）是将两种或两种以上的简单固定桥组合在一起而构成。当某个孤立基牙需要作前后缺隙的共同基牙时尤为常用，一般多为4个以上单位，有2个以上基牙，就位道比较困难时，其中一部分可设计为半固定桥。双端固定桥（E错）又称完全固定桥，两端都有固位体，且固位体与桥体之间为固定连接，并借固位体固定在基牙上，基牙、固位体、桥体成为一个整体，牙合力通过基牙传给牙周组织。双端固定桥与其他结构的固定桥相比，能承受的牙合力最大、患者感觉舒适、预后最佳，所以在临床上广泛应用。